肿疡半阴半阳证可用
A. 金黄膏
B. 疯油膏
C. 冲和膏
D. 生肌红玉膏
E. 生肌白玉膏

正确答案：C。冲和膏

解析：金黄膏长于除湿化痰，对肿而又结块，尤其是急性炎症控制后形成的慢性迁延性炎症更为适宜（A错）。疯油膏功能润燥杀虫止痒，适用于牛皮癣、慢性湿疮、皲裂等（B错）。冲和膏有活血止痛、疏风祛寒、消肿软坚的作用，适用于半阴半阳证（C对）。生肌玉红膏功能活血去腐、解毒止痛、润肤生肌收口，适用于一切溃疡腐肉未脱、新肉未生之时，或日久不能收口者（D错）。生肌白玉膏功能润肤生肌收敛，适用于溃疡腐肉已净、疮口不敛者，以及乳头皲裂、肛裂等病（E错）。